为Ⅱ型卡环的是
A. 隙卡
B. 倒钩卡环
C. 圈形卡环
D. 三臂卡环
E. 回力卡环

正确答案：B。倒钩卡环

解析：本题考查Ⅱ型卡环。Ⅱ型卡环适用于Ⅱ型观测线，Ⅱ型观测线：基牙向缺隙方向倾斜时所画出的导线，基牙主要倒凹区在近缺隙侧。Ⅱ型卡环，即铸造分臂卡环。分臂卡环的近缺牙区卡臂尖端在倒凹区，另一端在非倒凹区，起对抗平衡作用。该卡环的固位和支持作用好，但稳定作用稍差。倒钩卡环（B对）为Ⅱ型卡环，卡臂尖可进入基牙近缺隙侧的倒凹区。隙卡（A错）属于单臂卡环，位于基牙颊侧，其舌侧则用高基托起对抗臂的作用，不属于Ⅱ型卡环。Ⅰ型卡环的卡环臂在倒凹区，卡环体在非倒凹区，此类卡环的固位作用及卡抱稳定作用良好，圈形卡环（C错）、三臂卡环（D错）和回力卡环（E错）都属于Ⅰ型卡环，Ⅰ型导线卡环的卡环臂在倒凹区，卡环体在非倒凹区。